中切牙牙根唇侧比舌侧宽大是为了
A. 适应咬合力
B. 美观
C. 维护牙弓弧度
D. 以上都不对
E. 以上都对

正确答案：A。适应咬合力

解析：本题考查牙根形态的生理意义。中切牙牙根唇侧比舌侧宽大是为了适应咬合力（A对）。牙根的形态与牙所受咀嚼力方向也相关，上颌前牙受向前上的力，因此，上颌前牙牙根唇侧宽于舌侧；下颌牙受向内下方向的力，牙根的唇舌面宽度约相等。